在艾滋病相关牙周病中起重要作用的微生物是
A. 链球菌
B. 白色念珠菌
C. 病毒
D. 衣原体
E. 支原体

正确答案：B。白色念珠菌

解析：本题考查艾滋病的病因。艾滋病患者龈下菌斑中的白色念珠菌感染率检出率明显高于非艾滋病患者,因此艾滋病相关牙周病中起重要作用的微生物为白色念珠菌（B对）。与链球菌（A错）、病毒（C错）、衣原体（D错）、支原体（E错）无关。艾滋病的临床表现为线性红斑（LGE）,在龈缘处有明显的鲜红的宽约2～3mm的红边，且LGE与口腔白色念珠菌感染有关；坏死溃疡性龈炎；坏死溃疡性牙周炎；毛状白斑；kaposi肉瘤。